先天性甲状腺减低确诊需要哪项检査
A. T₄，TSH
B. GH测定
C. X线腕骨片
D. 染色体检查
E. T₃，TSH

正确答案：A。T₄，TSH

解析：先天性甲状腺功能减退症多见于儿童，常见表现为呆小症、生长发育迟缓和基础代谢减低，其发病机制为各种病因引起的甲状腺激素分泌减少。血甲状腺激素减少，对下丘脑（TRH）-腺垂体（TSH）-甲状腺（主要为T₄）负反馈抑制作用减弱，血清TSH增高。T₃主要由周围组织T₄转化而来，甲减时T₃可正常或减低。因此先天性甲减时最有助于确诊的为T₄，TSH（A对E错）。GH测定（B错）为生长激素测定，主要用于侏儒症或巨人症的诊断。X线腕骨片（C错）主要用于了解骨龄、判断生长发育情况。染色体检查（D错）主要用于检查遗传性疾病。